与心身疾病的诊断无关的是
A. 根据临床症状、体征和特殊检查明确器质性改变
B. 疾病的发生有相平行的心理社会因素
C. 排除神经症和精神疾病
D. 单纯的生物医学疗法收效甚微
E. 由某种躯体疾病引发心理障碍

正确答案：E。由某种躯体疾病引发心理障碍